在肾小管中，弱酸性药物在酸性尿液中的特点是
A. 解离多，重吸收少，排泄快
B. 解离少，重吸收多，排泄慢
C. 解离多，重吸收多，排泄慢
D. 解离少，重吸收少，排泄快
E. 解离多，重吸收多，排泄快

正确答案：B。解离少，重吸收多，排泄慢

解析：本题考查药物的排泄。酸性药物在pH低的，碱性药物在pH高的环境中非解离型药物增加，因此酸化尿液，弱酸性药物清除减少，重吸收多（B对）。